上颌侧切牙舌面窝发生龋称为
A. 浅龋
B. 中龋
C. 深龋
D. 平滑面龋
E. 窝沟龋

正确答案：E。窝沟龋

解析：上前牙的腭面尤其是上颌侧切牙的舌侧窝，是龋最好发的部位，临床上最为多见。掌握“龋病的临床表现与分类”知识点。